在病例对照研究中，估计某因素与疾病的联系程度，应计算
A. RR
B. RR-1
C. OR
D. OR-1
E. P1-PO

正确答案：C。OR

解析：病例对照研究不能计算发病率，也就无法得到RR，只能以OR估计RR（C对），并以此估计暴露与疾病之间的关联强度。OR（比值比，也称优势比或交叉乘积比）（P066）是病例组的暴露比值与对照组的暴露比值之比。RR（相对危险度，也称危险比或率比）（P057）是暴露组发病率（或死亡率）与非暴露组发病率（或死亡率）的比值。